乳房的血供来源为
A. 胸廓内动脉的穿支
B. 胸廓内动脉的肋间支
C. 胸外侧动脉的乳房外侧支
D. 胸主动脉的肋间动脉
E. 以上都是

正确答案：E。以上都是

解析：胸廓内动脉的穿支、肋间支、乳房外侧支、胸主动脉的肋间动脉（ABCD对，故E为本题正确答案）均为乳房的血供来源。